女，35岁。某大学教师。3个月前因出国问题与领导争吵，而后逐渐表现出情绪低落，兴趣减退，对未来悲观失望，认为领导和同事都疏远她，常有怨天尤人的表现。能主动求医，接触良好。针对此例，在心理评估上宜采用
A. 调查法
B. 观察法
C. 会谈法
D. 作品分析法
E. 心理测验法

正确答案：C。会谈法

解析：根据本例患者的求医需求及实际情况，在心理评估上，宜采用会谈法（C对），会谈的形式包括自由式会谈和结构式会谈两种。前者的谈话是开放式的，气氛比较轻松，被评估者较少受到约束，使他们有更多的机会表述自己的想法。结构式会谈是根据评估目的预先设计一定的结构和程序，谈话内容有所限定，效率相对较高。一般可编制一个评估大纲或评估表，在会谈时逐项提问，再根据受试者的回答进行定。会谈是一种互动的过程。在会谈中评估者起着主导和决定的作用。